下述情形中，不属于国家、集体医疗机构中的医师在执业活动中享有的权利的是
A. 出具相应的医学证明文件
B. 人格尊严、人身安全不受侵犯
C. 获取工资报酬和津贴
D. 私人营利性医疗服务
E. 享受国家规定的福利待遇

正确答案：D。私人营利性医疗服务

解析：医师在执业活动中享有下列权利主要是：①在注册的执业范围内，进行医学诊查、疾病调查、医学处置、出具相应的医学证明文件，选择合理的医疗、预防、保健方案；②按照国务院卫生行政部门规定的标准，获得与本人执业活动相当的医疗设备基本条件；③从事医学研究、学术交流，参加医师协会和专业学术团体；④参加专业培训，接受继续医学教育；⑤在执业活动中，人格尊严、人身安全不受侵犯；⑥获取工资报酬和津贴，享受国家规定的福利待遇；⑦对所在机构的医疗、预防、保健工作和卫生行政部门的工作提出意见和建议，依法参与所在机构的民主管理。掌握“医师执业规则及培训、考核及法律责任”知识点。